男孩，5岁。水肿伴尿少3天。病前2天有“上感”史。查体：BP90/60mmHg，眼睑及颜面水肿，双下肢凹陷性水肿。实验室检查：血浆白蛋白22g/L，胆固醇7.2mmol/L，肾功能正常，血C31.25g/L，PPD试验（-）。尿常规：RBC10/HP，蛋白（++++）。若住院期间，患儿经限盐并给予大剂量呋塞米治疗后，尿量明显增加，水肿消退，但随后出现精神萎靡、头昏、乏力、恶心、呕吐、尿量明显减少。查体：BP66/45mmHg，四肢凉。最可能的并发症是
A. 低血容量休克
B. 急性肾衰竭
C. 肾上腺皮质功能不全
D. 电解质紊乱
E. 高血压脑病

正确答案：A。低血容量休克

解析：患者儿童，有上感病史，水肿伴尿少，低蛋白血症，大量蛋白尿，高脂血症，肾功能正常，血C3正常，大量蛋白尿，这些症状符合肾病综合征表现。低血容量休克是肾病综合征的并发症之一，可以由大量使用利尿剂，使血容量明显减少而导致，患儿在限盐并给予大剂量呋塞米治疗后，出现精神萎靡、头昏、乏力、恶心、呕吐、尿量减少，提示由于大量利尿而出现低血容量休克（A对）。急性肾衰竭少尿期常表现为水肿、高血压，该患儿水肿消退，血压降低，不符合急性肾衰竭的诊断（B错）。肾上腺皮质功能不全（C错）和高血压脑病（E错）常不是肾病综合征的并发症。电解质紊乱是是肾病综合征的并发症之一，常见的电解质紊乱有低钠、低钾及低钙血症，但该患儿血压下降明显，更符合低血容量休克的诊断（D错）。